不属于生物性致病因素的是
A. 病毒
B. 细菌
C. 四氯化碳
D. 立克氏体
E. 疟原虫

正确答案：C。四氯化碳

解析：病毒（A对），细菌（B对），立克次氏体（D对），疟原虫（E对）属于生物致病因素；四氯化碳不属于致病因素（C错，为本题正确答案）。